治疗肺结核阴阳两虚证，应首选
A. 补天大造丸
B. 保真汤
C. 保元汤
D. 补肺汤
E. 月华丸

正确答案：A。补天大造丸

解析：补天大造丸（A对）可以滋阴补阳，益肾养精，故用于治疗肺结核阴阳两虚证。保真汤（B错）可益气养阴，用于治疗气阴耗伤证。保元汤（C错）可治阴阳两虚证。补肺汤（D错）可补益肺气，用治肺气虚耗证。月华丸（E错）可滋阴润肺，治疗肺阴亏损证。